男，35岁。反复心悸10余年，突发突止，发作时查体，心率180次/分，节律规整，心电图示QRS波群形态和时限正常。最可能的诊断为
A. 室性心动过速
B. 室性心动过缓
C. 阵发性心房颤动
D. 阵发性心房颤动伴差异性传导
E. 阵发性室上性心动过速

正确答案：E。阵发性室上性心动过速

解析：中年男性患者，反复心悸、突发突止（突发突止的心悸是阵发性室上性心动过速的典型特点），心率180次/分（阵发性室上性心动过速心率为150～250次/分），节律规整（阵发性室上性心动过速心律绝对规则），心电图示QRS波群形态和时限正常（阵发性室上性心动过速的心电图表现）。综合患者的病史、心电图查体结果，最可能的诊断是阵发性室上性心动过速（E对）。室性心动过速（A错）（P198）心室率通常为100～250次/分，QRS波形态畸形，时限超过0.12秒。室性心动过缓（B错）心率一般低于60次/分。阵发性心房颤动（C错）（P188）P波消失，出现f波，心室率极不规则。阵发性心房颤动伴差异性传导（D错）（P188）QRS波增宽变形。